与胎儿胎盘功能关系密切的激素是
A. 胎盘生乳素
B. 孕酮
C. 雌酮
D. 雌二醇
E. 雌三醇

正确答案：E。雌三醇

解析：雌激素首先是通过胆固醇在胎盘内转变为孕烯醇酮后，经胎儿肾上腺胎儿带转化为硫酸脱氢表雄酮，再经胎儿肝内的16α-羟化酶作用形成16α-羟基硫酸脱氢表雄酮后，在胎盘合体滋养细胞酯酶作用下，去硫酸根形成16α-OH-DHA，随后经胎盘芳香化酶作用成为16α-羟基雄烯二酮，最终形成游离雌三醇。可见，雌三醇是胎儿与胎盘共同参与合成的。因此，检测孕妇血中雌三醇的含量，可反映胎儿在子宫内的情况，可用来判断胎儿是否存活（E对）。孕酮（B错）由成熟卵泡的颗粒细胞合成的，与胎盘功能关系无明显关系。根据两细胞-两促性腺激素学说，雌二醇（D错）、雌酮（C错）是由卵泡膜细胞和颗粒细胞合成的，故与胎盘功能无明显关系。胎盘生乳素（A错）也是胎盘合成的，与胎儿胎盘功能关系没有雌三醇密切。